男，60岁。发热伴寒战、心悸7天，体温最高39度，头痛、咳嗽，右大腿肿痛，病情渐重入院。查体：T38度，P100次/分，R24次/分，BP100/75mmHg。神志清楚，巩膜轻度黄染，双肺呼吸音粗，无啰音，心脏无异常，腹平软、无压痛，肝区无叩痛。右大腿中段红肿，范围约10cm，压痛明显，有波动感。血WBC20×10⁹/L，Hb100g/L，多次血培养（-）。该患者目前最可能的诊断是
A. 脓毒症
B. 肝脓肿
C. 菌血症
D. 急性肺炎
E. 感染性休克

正确答案：A。脓毒症

解析：该患者右大腿中段红肿，压痛明显，有波动感，为原发感染病灶。在此基础上患者出现寒战、高热、白细胞明显增高（白细胞正常值为4～10×10⁹/L），提示由局部感染灶引发全身性感染（包括菌血症、脓毒症等）。脓毒症（七版黄家驷外科学P117）的确诊必须具备两个条件：①有活跃的细菌感染的确实证据，但血培养不一定为阳性；②有SIRS，即全身性炎症反应综合征。SIRS的四项标准符合两项即可诊断：体温＞38℃或＜36℃；心率＞90次/分；呼吸＞20次/分或有过度通气致PaCO₂＜4.3（32mmHg）；白细胞计数＞12×10⁹/L或＜4×10⁹/L，或幼稚细胞＞0.10。该患者有活跃的细菌感染的确实证据（发热伴寒战，右大腿中段红肿，压痛明显，有波动感），有SIRS（P100次/分，R24次/分，WBC20×10⁹/L）。综上，该患者目前的最可能诊断是脓毒症（A对）。肝脓肿（B错）的主要症状是寒战、高热，肝区疼痛和肝肿大。菌血症（P114）（C错）的诊断依据是血培养阳性。急性肺炎（D错）通常缘于上呼吸道感染，主要表现为发热、咳嗽、气促、肺部啰音等症状，一般不会出现巩膜黄染。该患者血压100/75mmHg，未达到休克诊断标准（收缩压＜90mmHg，脉压<20mmHg），不能诊断为感染性休克（E错）。